女，24岁。人工流产术出现血压下降，心率减慢，面色苍白，应考虑诊断为
A. 人工流产综合征
B. 子宫穿孔
C. 栓塞
D. 漏吸
E. 吸宫不全

正确答案：A。人工流产综合征

解析：患者为青年女性，人流术中出现血压下降、心率减慢、面色苍白（人工流产综合反应指手术时疼痛或局部刺激，使受术者在术中或术毕出现恶心呕吐、心动过缓、心律不齐、面色苍白、头昏、胸闷、大汗淋漓），应考虑诊断为人工流产综合反应（A对），主要为迷走神经兴奋所致。子宫穿孔（P383）（B错）会突然感到无宫底，或手术器械进入深度超过原来所测得深度。羊水栓塞（P384）（C错）在人工流产术少见，往往由于宫颈损伤、胎盘剥离使血窦开放，为羊水进入创造条件，即使并发羊水栓塞，其症状及严重性不如晚期妊娠发病凶猛。漏吸（P384）（D错）是指施行人工流产术未吸出胚胎及绒毛而导致继续妊娠或胚胎停止发育。吸宫不全（P384）（E错）指人工流产术后部分妊娠组织物的残留，表现为手术后阴道流血时间长，血量多或流血停止后再现多量流血。